非甾体抗炎药的作用特点，正确的是
A. 可产生中等程度的镇痛作用
B. 属于中枢性镇痛药
C. 对各种创伤引起的刷烈疼痛和内脏平滑肌绞痛无效
D. 只能降低发热者的体温，而对体温正常者无影响
E. 通过抑制中枢部位的前列腺素合成发挥解热作用

正确答案：A、C、D、E。可产生中等程度的镇痛作用；对各种创伤引起的刷烈疼痛和内脏平滑肌绞痛无效；只能降低发热者的体温，而对体温正常者无影响；通过抑制中枢部位的前列腺素合成发挥解热作用

解析：本题考查非甾体抗炎药的作用特点。非甾体抗炎药的作用特点：1.解热作用：NSAID通过抑制中枢前列腺素的合成发挥解热作用（E对），使发热者的体温下降，而对正常体温没有影响（D对）；2.镇痛作用：NSAID产生中等程度的镇痛作用（A对），镇痛作用部位主要在外周。对各种创伤引起的剧烈疼痛和内脏平滑肌绞痛无效（C对）；3.抗炎作用；4.抗风湿作用；5.抑制血小板聚集；6.预防肿瘤。